男性，45岁。左上后牙饮用冷、热水时疼痛。无自发痛。口腔检查：左上后牙未探及明显龋洞，叩诊（-），左上6（牙合）面远中牙体颜色稍显暗黑色。为确定诊断，应采用的辅助检查方法是
A. 实验性备洞
B. X线片检查
C. 牙周探诊
D. 选择性麻醉定位
E. 咬诊

正确答案：B。X线片检查

解析：本题考查龋病的诊断方法。男性，45岁。左上后牙饮用冷、热水时疼痛。无自发痛。口腔检查：左上后牙未探及明显龋洞，叩诊（-），左上6（牙合）面远中牙体颜色稍显暗黑色。为确定诊断，应采用的辅助检查方法是X线片检查（B对）。左上6（牙合）面远中龋坏为邻面龋，邻面龋确诊应采用的辅助检查为X线片检查。实验性备洞是指用牙钻磨除牙本质来判断牙髓活力的方法，是判断牙髓活力最可靠的检查方法，但会造成完好牙体组织或修复体的破坏，不建议使用（A错）。牙周探诊是牙周炎诊断中最重要的检查方法（C错）。选择性麻醉定位是通过局部麻醉的方法来判定引起疼痛的患牙（D错）。咬诊可用于检查牙隐裂，不能用于龋病的检查（E错）。